长期用药易发生低镁血症的药物是
A. 奥美拉唑
B. 胶体果胶铋
C. 替普瑞酮
D. 复方碳酸钙
E. 法莫替丁

正确答案：A。奥美拉唑

解析：本题考查奥美拉唑。长期用药易发生低镁血症的药物是奥美拉唑（A对）；服用胶体果胶铋（B错）颗粒或胶体果胶铋干混悬剂，偶可出现恶心、便秘等消化道症状；替普瑞酮（C错）的不良反应有肝功能障碍及黄疸等；复方碳酸钙（D错）服用后易出现呃逆、腹胀和嗳气，甚至引起反跳性胃酸分泌增加；服用法莫替丁（E错），少数患者可有口干，头晕、失眠、便秘、腹泻皮疹、面部潮红、白细胞减少，偶有轻度一过性转氨酶增高等。